HLAⅠ类抗原不在下列哪一种细胞表面表达
A. 淋巴细胞
B. 成熟红细胞
C. 巨噬细胞
D. 网织红细胞
E. 粒细胞

正确答案：B。成熟红细胞

解析：HLA按其分类和功能可分为HLAI类、HLAⅡ类和免疫功能相关基因。HLAI类分子由重链和β₂m组成，分布于所有有核细胞表面（ACDE对）。成熟红细胞无细胞核，因此，成熟红细胞（B错，为本题正确答案）不具有HLAⅠ类抗原。HLAⅡ类分子仅表达于淋巴组织中一些特定的细胞表面，如专职性抗原提呈细胞、胸腺上皮细胞和活化的T细胞等。